上颌义齿远中游离端基托后缘的两侧应伸展到
A. 磨牙后垫
B. 上颌结节
C. 翼上颌切迹
D. 腭小凹
E. 软硬腭交界稍后的软腭上

正确答案：C。翼上颌切迹

解析：翼上颌切迹：翼上颌切迹位于上颌结节后方，为蝶骨翼突与上颌结节后缘之间的骨间隙，表面覆盖黏膜凹陷成切迹状，是颊侧前庭的后缘，也是上颌总义齿两侧后缘的界限，又称翼突切迹。掌握“无牙颌的解剖标志及功能分区”知识点。